女性，60岁。反复咳嗽、咳痰25年，心悸、气促、下肢间歇水肿3年，病情加重伴畏寒发热1周入院。体检：T38℃，呼吸急促，口唇发绀，双肺叩诊过清音，中下肺有湿啰音，心率110次/分，心律齐，无杂音，双下肢重度水肿。假设该病例呼吸困难突然进一步加重，右肺呼吸音明显较前减弱，应立即进行的检查是
A. 胸部X线
B. 心电图
C. 动脉血气分析
D. 肺功能
E. 胸腔B超

正确答案：A。胸部X线

解析：患者老年女性，反复咳嗽、咳痰25年（为慢阻肺的标志性症状），查体双肺叩诊过清音，诊断为慢性阻塞性肺疾病（COPD）。患者有下肢间歇水肿病史3年，现双下肢重度水肿，表明已出现右心衰竭，考虑慢性肺源性心脏病。呼吸困难突然进一步加重，右肺呼吸音明显较前减弱，考虑并发了自发性气胸，应立即行胸部X线检查（A对），以明确诊断。心电图检查（B错）主要是了解各种心律失常、心肌缺血/梗死、房室肥大或电解质紊乱等。动脉血气分析（C错）多在病人昏迷、病情危重时了解病情严重程度。该病人呼吸急促，呼吸困难，不适合做肺功能检查（D错），因为肺功能检查需要患者配合做吹气运动，患者呼吸困难，不能够配合做吹气运动，且肺功能用来鉴别阻塞性和限制性通气功能障碍，不能诊断是否有气胸。胸腔B超（E错）探测胸腔积液的灵敏度高，定位准确，用于胸腔积液的检查。